治疗真菌性阴道炎首选的药物是
A. 伏立康唑片
B. 甲硝唑栓
C. 莫匹罗星软膏
D. 吲哚美辛栓
E. 硝酸咪康唑栓

正确答案：E。硝酸咪康唑栓

解析：本题考查阴道炎治疗药。治疗真菌性阴道炎首选的药物是硝酸咪康唑（E对）。真菌性阴道炎常选用制霉菌素、克霉唑、咪康唑、益康唑栓剂，首选硝酸咪康唑栓，次选克霉唑栓。伏立康唑片（A错）可用于治疗侵袭性曲霉病。甲硝唑栓（B错）是治疗滴虫性阴道炎首选的药物。莫匹罗星软膏（C错）可用于革兰氏阳性球菌引起的皮肤软组织的感染，如脓疱疮、疖、毛囊炎等原发性感染以及湿疹、皮炎、溃疡、外伤等皮肤病。吲哚美辛栓（D错）可用于小儿解热及缓解肌肉痛、关节痛。